下列食物中，铁的良好来源是
A. 小麦
B. 动物肝脏
C. 鱼
D. 蛋黄
E. 大豆

正确答案：B。动物肝脏

解析：食物中含铁丰富的有动物肝脏（B对），其次是瘦肉、蛋黄（D错）、鸡、鱼（C错）、虾和豆类（E错）。